腹痛的病因一般不包括
A. 情志失调
B. 跌仆损伤
C. 素体阳虚
D. 先天遗传
E. 外感时邪

正确答案：D。先天遗传

解析：情志失调，抑郁恼怒，肝失条达，气机不畅，气滞而痛；或忧思伤脾，或肝郁克脾，肝脾不和，气机不利，腑气通降不顺而发腹痛（A对）。跌仆损伤，络脉瘀阻，致腹中瘀血，中焦气机不利，不通则痛（B对）。素体阳虚，脾阳不振，寒湿内停，致脾阳衰惫，气血不足，不能温养脏腑，而成腹痛；或久病肾阳不足，肾失温煦，脏腑虚寒，腹痛日久，迁延不愈（C对）。先天遗传多导致禀赋不足，致后天易于患病，如虚劳等，但不是腹痛病因（D错，为本题正确答案）。外感时邪，如伤于风寒而致寒凝气滞，经脉受阻，不通则痛；如伤于暑邪，或寒邪不解，或湿热壅滞，可导致传导失职，腑气不通，而发为腹痛（E对）。